患者，男，58岁。胸满而痛，遇冷易诱发，伴下利，口不渴，不欲饮食，舌淡苔白，脉沉细而弦。治疗应选用
A. 大建中汤
B. 小建中汤
C. 厚朴温中汤
D. 吴茱萸汤
E. 理中丸

正确答案：E。理中丸

解析：患者胸满而痛，遇冷易诱发，伴下利，口不渴，不欲饮食，舌淡苔白，脉沉细而弦。皆由脾胃虚寒所致。中阳不足，寒从中生，阳虚失温，寒性凝滞，故畏寒肢冷、脘腹绵绵作痛、喜温喜按；脾主运化而升清，胃主受纳而降浊，今脾胃虚寒，纳运升降失常，故脘痞食少，呕吐，便溏；口不渴，舌淡苔白润，脉沉细或沉迟无力皆为虚寒之象。方用理中丸。麻黄辛温，开宣肺气以平喘，开腠解表以散邪；石膏辛甘大热，清泄肺热以生津，辛散解肌以透邪（E对）。大建中汤主治：中阳衰弱，阴寒内盛之脘腹剧痛证（A错）。小建中汤方证因中焦虚寒，肝脾失和，化源不足所致。本方既是温中补虚，缓急止痛之剂；又为调和阴阳，柔肝理脾之常用方（B错）。厚朴温中汤方证因脾胃伤于寒湿所致。为治疗脾胃寒湿气滞的常用方（C错）。吴茱萸汤方证由肝胃虚寒，浊阴上逆所致。本方为治疗肝胃虚寒，浊阴上逆的常用方（D错）。